为不规则形或长条形，切面黄色，外表可见横向环纹，味苦，微辛的是
A. 白蔹饮片
B. 秦艽饮片
C. 黄精饮片
D. 射干饮片
E. 天冬饮片

正确答案：D。射干饮片